位于上颌硬区之后，颤动线之前的大连接体
A. 前腭板
B. “天窗”式腭板
C. 前腭杆
D. 后腭杆
E. 侧腭杆

正确答案：D。后腭杆

解析：后腭杆：位于上颌硬区之后，颤动线之前，两端微弯向前至第一、第二磨牙之间。也可根据患者的敏感程度，适当调整其位置。因舌体不接触后腭杆，可做得稍厚些，中间较两端稍厚。掌握“局部义齿连接体”知识点。